HSV-1主要潜伏于
A. 口唇皮肤
B. 唾液腺
C. 脊髓后根神经节
D. 脑神经节
E. 三叉神经节和颈上神经节

正确答案：E。三叉神经节和颈上神经节

解析：HSV-1潜伏于三叉神经节和颈上神经节；HSV-2潜伏于骶神经节。掌握“疱疹病毒”知识点。